下列情况，需要紧急胆道减压的是
A. 胰头癌伴阻塞性黄疸
B. 十二指肠乳头癌伴阻塞性黄疸
C. 肝内肝外胆管结石
D. 结石在十二指肠乳头部嵌顿的急性化脓性胆管炎
E. 伴随剧烈绞痛的胆囊管结石嵌顿

正确答案：D。结石在十二指肠乳头部嵌顿的急性化脓性胆管炎

解析：结石在十二指肠乳头部嵌顿的急性化脓性胆管炎（D对）是急性胆管炎的严重阶段，原则上应立即解除胆道梗阻，以减小胆总管压力，当胆总管压力降低后，能有效阻止细菌和胆汁向血液的反流，病人情况能明显改善，所以需要紧急胆道减压。胰头癌伴阻塞性黄疸（A错）、十二指肠乳头癌伴阻塞性黄疸（B错）病因在于癌肿压迫或浸润胆总管，胆道减压对其无效。肝内肝外胆管结石（C错）治疗原则在于取净结石、清除病灶。伴随剧烈绞痛的胆囊管结石嵌顿（E错）应行胆囊切除。